一般1岁时体重可达出生时的
A. 1倍
B. 2倍
C. 3倍
D. 1.5倍
E. 2.5倍

正确答案：C。3倍

解析：一般在3~4个月时体重可达出生时的2倍，1岁时达3倍（10kg）。掌握“体格生长常用指标”知识点。